被称为“西医之父”的医学家是
A. 迈蒙尼提斯
B. 帕茨瓦尔
C. 阿维森纳
D. 希波克拉底
E. 胡佛兰德

正确答案：D。希波克拉底

解析：古希腊文化是西方文明的源头，伟大的医学家希波克拉底被称为西方医德的奠基人（西医之父），其著名的《希波克拉底誓言》对医生之间、医患之间的行为准则作了较系统的阐述，成为西方医学道德奠基的代表作，主张医生应该爱人类，立志献身医学（D对）。